根据《执业药师职业资格制度规定》，关于执业药师注册条件和要求的说法，错误的是
A. 取得执业药师职业资格证书并经注册方能执业
B. 首次注册应在取得职业资格证书后5年内申请注册
C. 遵纪守法，无不良信息记录
D. 身体健康，能坚持在执业药师岗位工作，并经执业单位考核同意

正确答案：B。首次注册应在取得职业资格证书后5年内申请注册

解析：本题考查的是执业药师的注册要求和条件。考生取得《执业药师职业资格证书》可以不注册，注册有效期为五年（B错，为本题正确答案）。执业药师的注册要求和条件：（1）注册要求：我国执业药师实行注册制度，国家药品监督管理局负责执业药师注册的政策制定和组织实施，指导全国执业药师注册管理工作。各省、自治区、直辖市药品监督管理部门负责本行政区域内的执业药师注册管理工作。取得执业药师职业资格的药学专业技术人员，经执业单位考核同意，通过全国执业药师注册管理信息系统向所在地注册管理机构申请注册。经批准注册者，由执业药师注册管理机构核发国家药监局统一样式的《执业药师注册证》，方可从事相应的执业活动（A对）。未经注册者，不得以执业药师身份执业。执业药师注册有效期为五年。需要延续的，应当在有效期届满三十日前，向所在地注册管理机构提出延续注册申请。（2）注册条件：申请注册的执业药师，必须具备以下条件：①取得《执业药师职业资格证书》；②遵纪守法，遵守执业药师职业道德，无不良信息记录（C对）；③身体健康，能坚持在执业药师岗位工作；④经执业单位考核同意（D对）。